磷脂属于
A. 乳化剂
B. 助悬剂
C. 两者均是
D. 两者均不是

正确答案：A。乳化剂

解析：本题考查表面活性剂。乳化剂分为表面活性剂类乳化剂、天然乳化剂、固体微粒乳化剂及辅助乳化剂，磷脂属于两性离子表面活性剂型乳化剂（A对）。助悬剂系指能增加分散介质的黏度以降低微粒的沉降速度或增加微粒亲水性的附加剂。常用的助悬剂有阿拉伯胶、聚维酮、甲基纤维素等（BCD错）。